第11～12胸椎受损伤可累及脊髓的节段是
A. 胸段
B. 腰段
C. 骶段
D. 腰、骶段
E. 骶、尾段

正确答案：B。腰段

解析：在脊髓节段中，腰髓节段约平对第10-12胸椎，所以第11～12胸椎受损伤可累及脊髓的节段是腰段（B对）。